牙根形成的多少取决于
A. 成釉器
B. 牙乳头
C. 牙囊
D. 上皮根鞘
E. 上皮隔

正确答案：E。上皮隔

解析：上皮隔是牙发育中，与牙根发育有关的结构；它是上皮根鞘向未来的根尖孔方向长出的盘状结构，与未来的牙长轴成约45度的弯曲，上皮隔的增生方式决定牙根的数量和形态。掌握“牙体、牙周组织的形成”知识点。